下列关于细胞黏附分子概念的描述正确的是
A. 细胞在正常分化、成熟、活化过程中，出现或消失的表面标记
B. 一类介导细胞间或细胞与细胞外基质（ECM）相互结合作用的跨膜糖蛋白
C. 由活化的细胞分泌的调节多种细胞生理功能的小分子多肽
D. 体液中正常存在的具有酶活性和自我调节作用的一组大分子系统
E. 是一组广泛参与免疫应答并代表个体特异性的抗原分子

正确答案：B。一类介导细胞间或细胞与细胞外基质（ECM）相互结合作用的跨膜糖蛋白

解析：细胞黏附分子（CAM）是一类介导细胞间或细胞与细胞外基质（ECM）相互结合作用的跨膜糖蛋白。掌握“白细胞分化抗原及黏附分子”知识点。